下列结构中不含有苯甲酰结构的是
A. 甲氧氯普胺
B. 多潘立酮
C. 西沙必利
D. 莫沙必利
E. 依托普利

正确答案：B。多潘立酮

解析：本题考查促胃肠动力药的结构特征。多潘立酮（B错，为本题正确答案）为较强的外周多巴胺D₂受体阻断药。分子中含有双苯并咪唑结构，不含苯甲酰结构，其他药物均含有苯甲酰结构。